内含雄黄的中成药是
A. 木瓜丸
B. 舒筋丸
C. 牛黄醒消丸
D. 苏合香丸
E. 独活寄生丸

正确答案：C。牛黄醒消丸

解析：本题考查的是含雄黄的中成药。内含雄黄的中成药是牛黄醒消丸（C对）。含雄黄的中成药：牛黄解毒丸（片）、六神丸、喉症丸、安宫牛黄丸、牛黄清心丸、牛黄镇惊丸、牛黄抱龙丸、牛黄至宝丸、追风丸、牛黄醒消丸、紫金锭（散）、三品等。木瓜丸（A错）含有乌头类药物。含乌头类药物的中成药：追风丸、追风透骨丸、三七伤药片、附子理中丸、金匮肾气丸、木瓜丸、小金丸、风湿骨痛胶囊、祛风止痛片、祛风舒筋丸、正天丸、右归丸等。舒筋丸（B错）含马钱子。含马钱子的中成药：九分散、山药丸、舒筋丸、疏风定痛丸、伤科七味片等。苏合香丸（D错）含朱砂。含朱砂、轻粉、红粉的中成药：牛黄清心丸、牛黄抱龙丸、抱龙丸、朱砂安神丸、天王补心丸、安神补脑丸、苏合香丸、人参再造丸、安宫牛黄丸、牛黄千金散、牛黄镇惊丸、紫雪散、梅花点舌丸、紫金锭（散）、磁朱丸、更衣丸、复方芦荟胶囊。独活寄生丸（E错）中不含毒性中药。